不属于急性病毒性心肌炎常见临床表现的是
A. 先有发热，然后出现心悸、胸闷
B. 恶心、呕吐等消化道症状
C. 可合并各种心律失常
D. 常出现器质性心脏杂音
E. 心动过速与发热程度平行

正确答案：E。心动过速与发热程度平行

解析：多数病人发病前1~3周有病毒感染前驱症状，如发热、全身倦怠感和肌肉酸痛，或恶心、呕吐等消化道症状（B对）。随后可以有心悸、胸痛、呼吸困难、水肿，甚至晕厥、猝死。临床诊断的病毒性心肌炎绝大部分是以心律失常（C对）为主诉或首见症状”（P271）“2.体征…心率可增快且与体温不相称（E错，为本题正确答案）。听诊可闻及第三、第四心音或奔马律，部分病人可于心尖部闻及收缩期吹风样杂音（D对）”。